感染性休克的临床特点是
A. 暖休克病人神志淡漠或嗜睡
B. 冷休克病人皮肤色泽淡红或潮红
C. 暖休克病人，每小时尿量大于30ml
D. 冷休克病人脉搏慢，搏动清楚
E. 暖休克病人毛细血管充盈时间延长

正确答案：C。暖休克病人，每小时尿量大于30ml

解析：暖休克病人神志清醒（A错），皮肤色泽淡红或潮红，脉搏慢，搏动清楚，毛细血管充盈时间1～2秒（E错），每小时尿量大于30ml（C对）。冷休克病人神志躁动、淡漠或嗜睡，皮肤色泽苍白、发绀或花斑样发绀（B错），脉搏细速（D错），毛细血管充盈时间延长，每小时尿量小于25ml。